女，45岁。反复双手近端指间关节、双膝关节痛，伴晨僵2年，肘部伸侧可触及皮下结节，质硬，无触痛。实验室检査：血RF1：40（﹢），ESR100mm/h。确诊后，最佳治疗药物是
A. 泼尼松
B. 阿司匹林
C. 青霉胺
D. 雷公藤
E. 金制剂

正确答案：B。阿司匹林

解析：中年女性患者（类风湿关节炎好发人群），反复双手近端指间关节、双膝关节痛（类风湿关节炎常见受累部位），伴晨僵2年，肘部伸侧可触及质硬、无痛性皮下结节（类风湿结节），RF（类风湿因子）阳性（80%左右类风湿关节炎可出现RF阳性），血沉加快，该患者最可能诊断为类风湿性关节炎。阿司匹林（B对）为非甾体类抗炎药，可减轻关节疼痛，为类风湿关节炎常用药。泼尼松（A错）虽具有强大的抗炎作用，能迅速缓解关节肿胀和关节痛，但应警惕感染、高血压、血糖增高等副作用，不宜长期使用。青霉胺（C错）和金制剂（E错）现已很少使用。雷公藤（D错）属于植物药制剂，对缓解关节症状有较好作用，但需进一步研究（P812）。